男性，27岁。心悸气短，胸闷胸痛晕厥。查体：胸骨左缘第3肋间3/6收缩期杂音，超声检查显示室间隔：左室后壁为1.5：1，SAM（+）。该患者的诊断是
A. 先天性室间隔缺损
B. 风心病累及二尖瓣主动脉瓣
C. 肥厚型梗阻性心肌病
D. 二尖瓣脱垂
E. 主动脉窦破裂

正确答案：C。肥厚型梗阻性心肌病

解析：患者青年男性，心悸气短，胸闷胸痛晕厥，胸骨左缘第3肋间可闻及3/6收缩期杂音（提示流出道梗阻），超声检查显示室间隔：左室后壁为1.5：1，SAM（+）（肥厚型梗阻性心肌病的特征性改变），综合患者的临床表现、体查和超声心动图检查，考虑该患者的诊断是肥厚型梗阻性心肌病（C对）。先天性室间隔缺损（P273）（A错）可有胸骨左缘第3～4肋间Ⅳ～Ⅵ全收缩期杂音；风心病累及主动脉瓣（B错）时可在胸骨左缘第3肋间（主动脉瓣第二听诊区）闻及杂音；主动脉窦是指主动脉瓣相对的动脉壁向外膨出，瓣膜与主动脉壁之间的内腔，若主动脉窦破裂（E错）进入右心室，也可在胸骨左缘第3肋间听到粗糙Ⅳ级连续性杂音，但这三种情况不会出现无室间隔肥厚和流出道梗阻的超声心动图表现。典型的二尖瓣脱垂（九版诊断学P153）（D错）的杂音为心尖区收缩中、晚期喀喇音合并收缩晚期杂音。